在职业卫生标准应用过程中，下列哪项是错误的
A. 我国职业卫生标准是实施卫生监督的依据
B. 我国的职业卫生标准具有法律效力
C. 职业卫生标准一经发布，各级管理部门和用人单位，都必须严格执行
D. 职业卫生标准一经发布，就是技术规范
E. 职业卫生标准一经发布，任何单位不得擅自更改和降低标准

正确答案：B。我国的职业卫生标准具有法律效力